石瘿的病因病理是
A. 肝郁胃热，夹痰上壅，气血凝滞，郁滞结喉
B. 情志内伤，肝脾气逆，气血湿痰，凝滞结喉
C. 肝肾不足，肾火郁结，夹痰上攻，凝滞结喉
D. 脾肾阳虚，脾虚不运，津液留聚，凝结颈部
E. 肺脾两亏，津液不布，留聚成痰，凝结颈部

正确答案：B。情志内伤，肝脾气逆，气血湿痰，凝滞结喉

解析：石瘿的致病因素多为情志内伤，其特点为结喉两侧结块，坚硬如石，高低不平，推之不移。石瘿发病时由于情志内伤，肝脾气逆，痰湿内生，气滞则血瘀，瘀血于痰湿凝结，上逆于颈部而成（B对ACDE错）。